牙槽龈组纤维
A. 纤维起于釉质牙骨质界下方的牙骨质，向外下方走行
B. 自牙颈部牙骨质，向牙冠方向散开，广泛地分布于牙龈固有层中
C. 自牙槽嵴向冠方牙龈固有层展开，止于游离龈
D. 起自根分叉处的牙根间骨隔顶，至根分叉区牙槽骨
E. 自牙颈部的牙骨质，越过牙槽嵴，止于牙槽突

正确答案：C。自牙槽嵴向冠方牙龈固有层展开，止于游离龈

解析：本题考查牙龈纤维-牙槽龈组。牙槽龈组纤维自牙槽嵴向冠方牙龈固有层展开，止于游离龈（C对）。牙龈纤维：龈牙组，自牙颈部牙骨质，向牙冠方向散开，止于游离龈和附着龈的固有层，广泛地分布牙龈固有层中（B错）；牙槽龈组，自牙槽嵴向冠方牙龈固有层展开，止于游离龈；牙骨膜组，自牙颈部的牙骨质，越过牙槽嵴，止于牙槽突（E错）。牙周膜纤维：牙槽嵴组，起于釉质牙骨质界下方的牙骨质，向外下方走行（A错）；根间组，起自根分叉处的牙根间骨隔顶，止于根分叉区牙骨质（D错）。